狂犬病病毒的基因组是
A. 双股环状DNA
B. 单股正链DNA
C. 双股环状RNA
D. 单股负链分节段RNA
E. 单股负链不分节段RNA

正确答案：E。单股负链不分节段RNA

解析：狂犬病病毒基因组为单股负链RNA（-ssRNA），长约12kb。G刺突与病毒对宿主细胞的吸附、感染及毒力有关，且有血凝作用和抗原性。掌握“狂犬病、人乳头瘤病毒”知识点。